有关流感病毒血凝素抗体的叙述错误的是
A. 是流感主要的保护性抗体
B. 血凝素抗体为型特异性抗体
C. 从呼吸道分泌物和血清中均可检出
D. 随着抗原漂移，其抗体保护性减弱
E. IgG在感染后4～7周达高峰

正确答案：B。血凝素抗体为型特异性抗体

解析：本题考查流感病毒血凝素抗体的相关内容。人感染流感病毒后可产生三种抗体：血凝素抗体、神经氨酸酶抗体和核蛋白抗体。其中血凝素抗体（HA抗体）（B错，为本题正确答案）是主要的保护性抗体（A对），它能结合并覆盖病毒的吸附位点，从而使流感病毒降低或失去吸附细胞的能力，因此能中和病毒。人感染病毒后4～7天在呼吸道分泌物和血清中即可检出HA抗体（C对）。HA抗体具有株特异性，随着抗原漂移，其保护性减弱（D对）。